以下有关“儿童多动症”的描述正确的是
A. 儿童多动症是以学习技能获得困难为主的一组综合征
B. 儿童多动症患儿的注意障碍、活动过度等表现大体和年龄相符
C. 儿童多动症患儿的学习困难、社会适应力低下主要由非智力因素引起
D. 儿童多动症的发病率女孩高于男孩
E. 儿童多动症有明确的先天遗传因素，与家庭、教养等环境无关

正确答案：C。儿童多动症患儿的学习困难、社会适应力低下主要由非智力因素引起